舍格伦综合征若压迫腺体，导管口流出的液体为
A. 絮状唾液
B. 少量黏稠而有咸味液体
C. 胶冻状液体
D. 黏稠脓性分泌物
E. 含有“硫磺颗粒”的脓液

正确答案：A。絮状唾液

解析：舍格伦综合征在检查时若压迫腺体则在导管口流出絮状唾液。掌握“坏死性唾液腺化生与舍格伦综合征”知识点。